老年人生理功能降低的主要表现不包括
A. 基础代谢降低
B. 细胞功能下降
C. 血脂水平增高
D. 心搏输出量增加
E. 骨关节退化

正确答案：D。心搏输出量增加